肝气犯胃所致胃痛的主要特征有
A. 胃脘刺痛
B. 食后痛减
C. 胃脘胀痛
D. 痛连胁肋
E. 嗳气痛减

正确答案：C、D、E。胃脘胀痛；痛连胁肋；嗳气痛减

解析：本题考查的是胃痛的辨证论治。肝气犯胃所致胃痛的主要特征有胃脘胀痛（C对）、痛连胁肋（D对）、嗳气痛减（E对）。胃痛又称胃脘痛，是以上腹胃脘部近心窝处疼痛为主要表现的疾病。西医学中胃炎、消化性溃疡、功能性消化不良等疾病以上腹部疼痛为主要表现者，可参考此内容辨证论治。肝气犯胃证【症状】胃脘胀痛，痛连两胁，遇烦恼则痛作或痛甚，嗳气、矢气则舒，脘闷嗳气，善太息，大便不畅。舌淡红，苔薄白，脉弦。